黄疸消退后，病体仍有气滞血瘀者，宜选用
A. 大黄䗪虫丸
B. 逍遥散合鳖甲丸
C. 血府逐瘀汤
D. 身痛逐瘀汤
E. 复元活血汤

正确答案：B。逍遥散合鳖甲丸

解析：黄疸消退后，体内仍有气滞血瘀，积块留着，治宜疏肝理气，活血化瘀，方用逍遥散合鳖甲丸（B对）。大黄䗪虫丸用于瘀血内停所致的癥瘕、闭经（A错）。血府逐瘀汤主治胸部的瘀血证（C错）。身痛逐瘀汤为瘀血腰痛代表方（D错）。复元活血汤用于治疗跌打损伤，胁下作痛（E错）。